接触职业性有害因素的劳动者是否发生职业性疾患主要取决于
A. 接触浓度（强度）和时间
B. 接触机会
C. 接触方式
D. 人体的健康状况
E. 每次接触量

正确答案：A。接触浓度（强度）和时间